IgA占血清免疫球蛋白总量的
A. 5%～10%
B. 10%～15%
C. 15%～20%
D. 25%～30%
E. 30%以上

正确答案：B。10%～15%

解析：本题考查各类球蛋白的特性和功能。IgA占血清免疫球蛋白总量的10%～15%（B对），是外分泌液中主要的抗体。